冬天某人进入浴室后不久便突然晕倒，其血流动力学的原始因素是
A. 全身血管收缩
B. 心输出量减少
C. 血管容量增加
D. 血流速度加速
E. 血量减少

正确答案：C。血管容量增加